脊柱前凸多发生的部位是
A. 颈段
B. 胸段
C. 胸腰部
D. 腰椎
E. 骶椎

正确答案：D。腰椎

解析：脊柱过度向前弯曲称为脊柱前凸，多发生于腰椎（D对），其特点为被检查者腹部明显向前突，臀部明显向后突，多见于妊娠晚期、大量腹水、腹腔巨大肿瘤、髋关节结核及先天性髋关节后脱位等。